右心衰竭时，产生水肿的主要始动因素是
A. 毛细血管滤过压增高
B. 毛细血管通透性增高
C. 水与钠潴留
D. 血浆胶体渗透压降低
E. 淋巴液回流受阻

正确答案：A。毛细血管滤过压增高

解析：毛细血管有效滤过压=（毛细血管血压＋组织液胶体渗透压）－（组织液静水压＋血浆胶体渗透压）（九版生理学P126），右心衰竭时，血液淤积于右心，使右心室舒张末期压力升高，静脉回流受阻，是全身毛细血管后阻力增大，导致毛细血管毛细血管滤过压增高（A对），引起全身水肿。毛细血管通透性增加（B错）常见于感染、烧伤、过敏等情况。水与钠潴留（C错）常见于肾炎性水肿（P465）。血浆胶体渗透压降低（D错）常见于营养不良或某些肝肾疾病。淋巴回流受阻（E错）常见于丝虫病患者的淋巴管被堵塞时。本题可参考九版生理学P126-P127。